胃癌最好发的部位是
A. 幽门管
B. 胃窦大弯侧
C. 胃体大弯侧
D. 胃窦小弯侧
E. 贲门小弯侧

正确答案：D。胃窦小弯侧

解析：胃癌最好发的部位是胃窦小弯侧（D对）。